经过卵圆孔的结构
A. 脑膜中动脉
B. 岩大神经
C. 上颌神经
D. 下颌神经
E. 无

正确答案：D。下颌神经

解析：脑膜中动脉（A想）自棘孔向外上方走行。岩大神经（B错）于破裂孔附近与颈内动脉交感丛发出的岩深神经合并成翼管神经，穿翼管入翼腭窝内的翼腭神经节。上颌神经（C错）在海绵窦外侧壁穿过。下颌神经（D对）经卵圆孔出颅后分为数支。